高肾素型高血压患者首选
A. 阿替洛尔或卡托普利
B. 美托洛尔或硝苯地平
C. 硝苯地平或卡托普利
D. 呋塞米或尼群地平
E. 硝普钠或硝酸甘油

正确答案：A。阿替洛尔或卡托普利